在坐骨大、小孔之间的是
A. 骶结节韧带
B. 骶棘韧带
C. 后纵韧带
D. 髂股韧带
E. 棘间韧带

正确答案：B。骶棘韧带

解析：骶棘韧带与坐骨大切迹围成坐骨大孔，骶棘韧带、骶结节韧带和坐骨小切迹围成坐骨小孔，骶棘既参与坐骨大孔的组成，也参与坐骨小孔的组成，所以说骶棘韧带（B对）位于坐骨大、小孔之间。